材料一：甲因其子（8周岁）连续咳嗽一周，到某药品零售连锁企业门店购药。当时该零售企业执业药师不在岗，由工作人员乙详细询问甲，了解患者是否发烧、是否咳痰，在得知未发烧、咳黄痰后，向甲推荐盐酸氨溴索口服液（按甲类非处方药管理）和维生C素泡腾片（按乙类非处方药管理），甲凭以往用药经验，向乙提出新的购药需求购买中成药抗病毒口服液（外包装上有绿色OTC标识）和小儿退烧药。甲购买药品给其子使用一周后，症状未改善。甲再次前往该门店，向门店执业药师表示想购买磷酸可待因糖浆给其子使用。根据背景材料，关于乙销售盐酸氨溴索口服液的说法，正确的是
A. 可以销售，但应提供必要的用药指导
B. 执业药师不在岗，不应销售
C. 没有见到患者本人，不应销售
D. 经与执业药师电话确认后可以销售

正确答案：B。执业药师不在岗，不应销售

解析：本题考查的是药品零售的经营行为管理要求。甲因其子（8周岁）连续咳嗽一周，到某药品零售连锁企业门店购药。当时该零售企业执业药师不在岗，由工作人员乙详细询问甲，了解患者是否发烧、是否咳痰，在得知未发烧、咳黄痰后，向甲推荐盐酸氨溴索口服液（按甲类非处方药管理）和维生C素泡腾片（按乙类非处方药管理），甲凭以往用药经验，向乙提出新的购药需求购买中成药抗病毒口服液（外包装上有绿色OTC标识）和小儿退烧药。甲购买药品给其子使用一周后，症状未改善。甲再次前往该门店，向门店执业药师表示想购买磷酸可待因糖浆给其子使用。根据背景材料，关于乙销售盐酸氨溴索口服液的说法，正确的是执业药师不在岗，不应销售（B对）。药品零售企业的药学技术人员配备要求：经营处方药、甲类非处方药的药品零售企业应当按照规定配备执业药师或者其他依法经过资格认定的药学技术人员，负责药品管理、处方审核和调配、指导合理用药以及不良反应信息收集与报告等工作。药品零售企业营业时间内，执业药师或者其他依法经过资格认定的药学技术人员应当在职在岗；未经执业药师审核处方，不得销售处方药。